下列哪一项生长发育指标较少受到遗传因素的影响
A. 身高
B. 体重
C. 坐高
D. 小腿长
E. 月经初潮

正确答案：B。体重